慢性胃炎的最主要病因是
A. 吸烟、饮酒
B. 十二指肠液反流
C. 自身免疫反应
D. 幽门螺杆菌感染
E. 不良饮食习惯

正确答案：D。幽门螺杆菌感染

解析：慢性胃炎最主要的病因是幽门螺杆菌（D对）。十二指肠液反流（B错）、自身免疫（C错）、年龄因素和胃粘膜营养因子缺乏也是慢性胃炎的病因。饮酒为急性胃炎病因，吸烟（A错）不是胃炎的病因；不良饮食习惯（E错）可使胃粘膜修复再生功能降低，为慢性胃炎的病因之一。